男，72岁。1年来阵发性腹痛，自觉有“气块”在腹中窜动，大便次数增加，近3个月腹胀、便秘，近3天无肛门排气、排便，呕吐物有粪便臭味，伴乏力、低热。禁忌使用的检査是
A. 结肠镜
B. 腹部CT
C. 腹部B超
D. 上消化道X线钡剂造影
E. 腹部X线平片

正确答案：D。上消化道X线钡剂造影

解析：老年男性患者，阵发性腹痛1年，腹胀、便秘3个月，近5天无肛门排气、排便（提示完全性肠梗阻），呕吐物有粪便臭味（提示低位肠梗阻），应考虑为低位完全性肠梗阻。肠梗阻病人严禁使用全消化道钡餐造影，否则可能造成钡剂堵塞肠管，加重病情（D错，为本题正确答案）。患者肠梗阻较轻，可行结肠镜（A对）检查。腹部X线平片（E对）、腹部B超（C对）、腹部CT（B对）禁忌极少，可作为辅助诊断措施。